具葡萄糖类似物，对α-葡萄糖苷酶有强效抑制作用的药物是
A. 格列齐特
B. 米格列奈
C. 二甲双胍
D. 盐酸吡格列酮
E. 米格列醇

正确答案：E。米格列醇

解析：本题考查米格列醇。米格列醇（E对）的结构与葡萄糖相似，能够可逆地竞争性抑制α-葡葡糖苷酶，减慢碳水化合物的水解以及葡萄糖的产生速度而降低餐后血糖。格列齐特（A错）为磺酰脲类促胰岛素分泌药。米格列奈（B错）为非磺酰脲类促胰岛素分泌药。二甲双胍（C错）为双胍类降糖药，降糖机制为增加基础状态下糖的无氧酵解，抑制肠道内葡萄糖的吸收，增加葡萄糖的外周利用等。盐酸吡格列酮（D错）为胰岛素增敏剂。